多巴胺舒张肾血管是由于
A. 激动β受体
B. 阻断α受体
C. 激动M胆碱受体
D. 激动多巴胺受体
E. 使组胺释放

正确答案：D。激动多巴胺受体

解析：多巴胺对血管的作用与用药浓度有关，低浓度时主要与位于肾脏、肠系膜和冠脉的多巴胺受体（D1）结合导致血管舒张。掌握“多巴胺和异丙肾上腺素”知识点。